在什么情况下，队列研究比病例对照研究有独特的优点
A. 研究时间不足时
B. 研究一种暴露与多种结局的关系
C. 资金缺乏
D. 研究的暴露因素可定量测定
E. 研究的疾病为某种不常见疾病时

正确答案：B。研究一种暴露与多种结局的关系